具有养阴生津功效的药物是
A. 生地黄
B. 牡丹皮
C. 赤芍
D. 紫草
E. 金银花

正确答案：A。生地黄

解析：生地黄的功效是清热凉血，养阴生津（A对）。牡丹皮（B错）的功效是清热凉血，活血化瘀。赤芍（C错）的功效是清热凉血，散瘀止痛。紫草（D错）的功效是清热凉血，活血解毒，透疹消斑。金银花（E错）的功效是清热解毒，疏散风热。